躯干、四肢深感觉传导路第3级神经元在
A. 脊神后角
B. 红核
C. 薄束核
D. 丘脑腹后外侧核
E. 楔束核

正确答案：D。丘脑腹后外侧核

解析：躯干和四肢意识性本体感觉和精细触觉传导通路的结构包括第1级神经元：脊神经节内假单极神经元，第2级神经元在薄束核（C错）和楔束核内（E错），二者发出的纤维在中线上交叉后形成内侧丘系交叉，第3级神经元的胞体在丘脑腹后外侧核（D对），最后经内囊投射至中央后回。